进入第二产程的标志是
A. 宫口开全
B. 胎头拨露
C. 产妇屏气，肛门放松
D. 宫缩时会阴膨出，肛门放松
E. 胎先露降至坐骨棘水平

正确答案：A。宫口开全